国家以保障公众用药安全为目标，以落实企业主体责任为基础，以实现“一物一码，物码同追”为方向，加快推进药品信息化追溯体系建设。其中关于“码”的说法，正确的是
A. 每一种药品有一个特定的追溯码
B. 同一个规格的药品有一个特定的追溯码
C. 同一个生产批号的药品有一个特定的追溯码
D. 每一个药品最小销售单元有一个特定的追溯码

正确答案：D。每一个药品最小销售单元有一个特定的追溯码

解析：本题考查一物一码的含义。国家以保障公众用药安全为目标以落实企业主体责任为基础以实现“一物一码，物码同追”为方向加快推进药品信息化追溯体系建设。其中关于“一物一码”的说法正确的是每一个药品最小销售单元有一个特定的追溯码（D对）。“物”指的是药品独立最小包装（ABC错），“码”是指药品信息码，含有生产厂家、批号等信息，且每一最小包装上的码都是唯一的。